作为软胶囊囊壁增塑剂的是
A. 醋酸纤维素
B. 单硬脂酸甘油酯
C. 山梨醇
D. 液体石蜡
E. 水

正确答案：C。山梨醇

解析：本题考查软胶囊的附加剂。软胶囊的囊壳由明胶、增塑剂、水三者构成，常用的增塑剂有甘油、山梨醇（C对）或两者的混合物。醋酸纤维素（A错）为水不溶性高分子薄膜材料。单硬脂酸甘油酯（B错）可作为滴丸剂的脂溶性基质。液体石蜡（D错）可作为水溶性基质滴丸剂的冷凝液。水（E错）可作为非水溶性基质滴丸剂的冷凝液。